依照《关于办理生产、销售伪劣商品刑事案件具体应用法律若干问题的解释》，应认定为“对人体健康造成严重危害”的是
A. 生产、销售不符合卫生标准的食品后，致人死亡的
B. 生产、销售假药，含有超标准的有毒有害物质的
C. 生产、销售假药，所标明的适应症超出规定范围，可能造成贻误诊治的
D. 生产、销售的假药被使用后，造成轻伤、重伤或者其他严重后果的
E. 生产、销售的有毒有害食品被食用后，致人严重残疾、十人以上轻伤的

正确答案：D。生产、销售的假药被使用后，造成轻伤、重伤或者其他严重后果的

解析：本题考查生产、销售、使用假药刑事责任认定及刑罚。依照《关于办理生产、销售伪劣商品刑事案件具体应用法律若干问题的解释》，应认定为“对人体健康造成严重危害”的是生产、销售的假药被使用后，造成轻伤、重伤或者其他严重后果的（D对）。根据《最高人民法院、最高人民检察院关于办理危害药品安全刑事案件适用法律若干问题的解释》（高检发释字〔2022〕1号）第二条规定，生产、销售、提供假药，具有下列情形之一的，应当认定为刑法第一百四十一条规定的“对人体健康造成严重危害”：①造成轻伤或者重伤的；②造成轻度残疾或者中度残疾的；③造成器官组织损伤导致一般功能障碍或者严重功能障碍的；④其他对人体健康造成严重危害的情形。生产、销售、提供假药，具有下列情形之一的，应当认定为刑法第一百四十一条规定的有“其他严重情节”：①造成较大突发公共卫生事件的；②生产、销售金额二十万元以上不满五十万元的；③生产、销售金额十万元以上不满二十万元，并具有本解释第一条规定的应当酌情从重处罚情形之一的；④根据生产、销售的时间、数量、假药种类等，应当认定为情节严重的。生产、销售、提供假药，具有下列情形之一的，应当认定为刑法第一百四十一条规定的有“其他特别严重情节”：①致人重度残疾的；②造成三人以上重伤、中度残疾或者器官组织损伤导致严重功能障碍的；③造成五人以上轻度残疾或者器官组织损伤导致一般功能障碍的；④造成十人以上轻伤的；⑤造成重大、特别重大突发公共卫生事件的；⑥生产、销售、提供假药的金额五十万元以上的；⑦生产、销售金额二十万元以上不满五十万元，并具有本解释第一条规定的应当酌情从重处罚情形之一的；⑧根据生产、销售的时间、数量、假药种类等，应当认定为情节特别严重的。